“救死扶伤”一词最早出自于
A. 《希波克拉底》誓言
B. 《报任少卿书》
C. 《黄帝内经》
D. 《大医精诚》
E. 《伤寒杂病论》

正确答案：B。《报任少卿书》

解析：“救死扶伤”一词最早出自汉代司马迁的《报任少卿书》，其中写道“与单于连战十有余日，所杀过半当，虏救死扶伤不给”。掌握“医学伦理的指导原则”知识点。